黄连配木香属于药物七情中的
A. 相须
B. 相使
C. 相反
D. 相畏
E. 相恶

正确答案：B。相使

解析：相使就是在性能功效方面有某些共性，或性能功效虽不相同，但是治疗目的一致的药物配合应用，其中以一种药物为主，另一种药物为辅，两药合用，辅药可以提高主药的功效。如黄连配木香治湿热泻痢，腹痛里急，黄连为清热燥湿、解毒止痢的主药，木香调中宣滞、行气止痛，可增强黄连清热燥湿、行气化滞的功效（B对）。相须（A错）就是两种性能功效类似的药物配合应用，可以増强原有药物的功效。全蝎、蜈蚣同用能明显增强平肝息风，止痉定搐的作用。相反（C错）是指两种药物同用能产生或增强毒性或副作用，如甘草反甘遂。相畏（D错）是指一种药物的毒性或副作用能被另一种药物降低或消除。如半夏畏生姜。相恶（E错）是指两药合用，一种药物能使另一种药物原有功效降低，甚至丧失。如人参恶莱菔子，莱菔子能削弱人参的补气作用。